慢性焦虑状态即普遍性焦虑症一般不包括的症状是
A. 震颤
B. 胸部紧压感
C. 出汗、面色苍白、心跳加快
D. 尿频、尿急
E. 气透不过来，濒死感

正确答案：E。气透不过来，濒死感

解析：气透不过来，濒死感为惊恐障碍的临床症状（E错，为本题正确答案）。慢性焦虑状态（普遍性焦虑症）又称广泛性焦虑障碍，其临床表现为：1.精神性焦虑：精神上的过度担心是焦虑症状的核心；2.躯体性焦虑：表现为运动性不安与肌肉紧张。可出现肢体震颤（A对），甚至语音发颤。3.自主神经功能紊乱：胸部紧压感（B对）、出汗或苍白、心跳过快（C对）、尿频尿急（D对）、胃部不适等。